川崎病的诊断标准不包括
A. 手足皮肤广泛硬性水肿，继之手掌、脚底有弥漫性红斑或膜样脱皮
B. 遍布全身的荨麻疹样、麻疹样、猩红热样皮疹
C. 双眼球结膜充血、唇红干裂和杨梅舌
D. 发热呈稽留热或弛张热
E. 关节疼痛、肿大

正确答案：E。关节疼痛、肿大

解析：川崎病，曾称皮肤黏膜淋巴结综合征（MCLS），诊断标准有6点，必备1条：发热5天以上，呈稽留热或弛张热（D对），抗生素治疗无效（与一般感染性发热鉴别）。下面5项中符合4项或者超声心动图证实有冠脉损害，排除其他疾病，即可诊断。1）唇充血皲裂，口腔黏膜弥漫充血，舌乳头突起，充血，呈草莓舌；2）眼结膜非化脓性充血（C对）；3）颈淋巴结肿大；4）四肢变化：急性期掌跖红斑，手足硬性水肿，恢复期指（趾）端膜状脱皮（A对）；5）多形性皮疹：包括荨麻疹样、麻疹样、猩红热样皮疹（B对）等。川崎病的诊断可简记为：1（一个嘴巴）2（两个眼睛）3（三个指头触诊淋巴结）4（四肢变化）5（多形性皮疹+发热超五天）（P193）。关节疼痛，肿胀（E错，为本题正确答案）在儿科疾病主要见于风湿热，典型表现为游走性多关节炎（P155）。